高温作业厂房有组织自然通风的基本原理是
A. 利用风压
B. 利用负压
C. 利用热压
D. 利用风压和热压
E. 利用热压和负压

正确答案：D。利用风压和热压

解析：本题考查高温作业厂房通风原理。热量大、热源分散的高温车间，每小时需换气30～50次以上，才能使余热及时排出。此时必须把进风口和排风口配置得十分合理，充分利用热压和风压（D对ABCE错）的综合作用，使自然通风发挥最大的效能。